流行病学研究方法包括
A. 描述疾病在人群、时间及空间的分布
B. 病例对照研究及定群研究
C. 现况调查
D. 个案调查
E. 描述性研究、分析性研究、实验性研究、理论性研究

正确答案：E。描述性研究、分析性研究、实验性研究、理论性研究